可引起周围神经炎的是
A. 异烟肼
B. 利福平
C. 乙胺丁醇
D. 吡嗪酰胺
E. 卡那霉素

正确答案：A。异烟肼

解析：本题考查异烟肼的不良反应。可引起周围神经炎的是异烟肼（A对）。异烟肼为维生素B₆的拮抗剂，可增加维生素B₆经肾排出量，易致周围神经炎的发生。同时服用维生素B₆者，需酌情增加用量。
利福平（B错）不良反应常见消化道反应、肝毒性、类流感样综合征等。乙胺丁醇（C错）不良反应为球后视神经炎、胃肠道反应、过敏反应等。吡嗪酰胺（D错）不良反应有肝脏损害，如血清转氨酶升高，甚或出现黄疸。卡那霉素（E错）不良反应主要有耳毒性、肾毒性和胃肠道反应。